患者，男，70岁，因抑郁症长期服用舍曲林。新诊断为帕金森病，宜选用的药物有
A. 司来吉兰
B. 普拉克索
C. 金刚烷胺
D. 吡贝地尔
E. 恩他卡朋

正确答案：B、C、D、E。普拉克索；金刚烷胺；吡贝地尔；恩他卡朋

解析：本题考查抗帕金森病药物。新诊断为帕金森病，宜选用的药物有普拉克索（B对）、金刚烷胺（C对）、吡贝地尔（D对）、恩他卡朋（E对）。常用的治疗帕金森的药物有：①抗胆碱能药物（苯海索）。②促多巴胺释放剂（金刚烷胺）。③复方左旋多巴（左旋多巴/苄丝肼和左旋多巴/卡比多巴）。④多巴胺受体激动剂（普拉克索、吡贝地尔）。⑤儿茶酚-O-甲基转移酶(COMT）的选择性、可逆性抑制药（恩他卡朋）。⑥单胺氧化酶B（MAO-B）抑制剂（司来吉兰）（A错）。